患儿咳喘反复发作，面色㿠白，形寒怯冷，下肢不温，脚软无力，大便澄清。其证候是
A. 肺气虚弱
B. 脾虚气弱
C. 肾虚不纳
D. 肺脾气虚
E. 阴虚肺热

正确答案：C。肾虚不纳

解析：患儿咳喘反复发作，当属哮喘，其肾虚不纳，肾为元气之根，肾气亏乏，故下肢不温，脚膝酸软。阳气不足，故面色㿠白、形寒怯冷，肾主二便，肾虚则大便澄澈清冷，膀胱不能制约，则小便自遗（C对）。肺气虚弱见面色㿠白，气短懒言，语声低微，倦怠乏力，自汗怕冷，四肢不温，苔薄质淡，脉细无力（A错）。脾虚气弱见咳嗽痰多，食少纳呆，面色萎黄欠华，大便不实等（B错）。肺脾气虚多反复感冒，气短自汗，咳嗽无力，神疲懒言，形瘦纳差，面白少华，便溏，舌质淡，苔薄白，脉细软（D错）。阴虚肺热常见咳嗽，面色潮红，夜间盗汗，五心烦热等（E错）。